患者，女，35岁。性交后阴道流血2个月，妇科检查见宫颈中度糜烂，宫颈活组织检查示异型细胞占据上皮层的下1/3～2/3。应首选的治疗措施是
A. 暂时按炎症处理
B. 行子宫全切除术
C. 行激光冷凝等治疗，术后定期随访
D. 行子宫全切及双侧附件切除术
E. 暂不需处理，随访观察

正确答案：C。行激光冷凝等治疗，术后定期随访

解析：CIN Ⅱ级∶即中度异型。上皮下1/3～2/3层细胞核明显增大，核质比例增加，核深染，核分裂象较多，细胞数量明显增多，细胞极性尚存，故患者诊断为CIN Ⅱ。约20%CIN Ⅱ会发展为原位癌，5%发展为浸润癌，故CIN Ⅱ需治疗（AE错），阴道镜检查满意的宫颈CIN Ⅱ者可做物理治疗或宫颈锥切术（C对）。CIN I60%～85%CINI会自然消退，故对活检证实为CIN I并有随访条件者，可每6个月复查一次细胞学或高危型HPV-DNA，若在随访过程中病变发展或持续存在2年，应进行冷冻或激光治疗术。阴道镜不满意的宫颈CIN Ⅱ者和所有的CIN Ⅲ者都应采用宫颈锥切术，包括宫颈环形电切除术（LEEP）和冷刀锥切术（CKC）。经宫颈锥切确诊、年龄较大、无生育要求的CIN Ⅲ者也可行全子宫切除术（BD错）。